患者，男，58岁。胸痛反复发作2年。2小时前，胸痛再次发作，持续不缓解，烦躁不安，大汗淋漓。经检查诊断为急性前间壁心肌梗死。其心电图特征性改变出现的导联是
A. V₁、V₂、V₃
B. Ⅱ、Ⅲ、aVF
C. V₁、V₂、V₃、V₄、V₅
D. V₁、V₂、V₃、aVF、Ⅱ、Ⅲ
E. V₅、V₆、V₇

正确答案：A。V₁、V₂、V₃

解析：前间壁心肌梗死特征性心电图改变，常常表现在V₁、V₂、V₃导联（A对）。前壁心梗表现在V₃、V₄、V₅导联。前侧壁心梗表现在V₅、V₆、V₇导联（E错）。广泛前壁心梗表现在V₁～V₆导联（C错）。下壁心梗表现在Ⅱ、Ⅲ、aVF导联（B错）。后壁心梗表现在V₇～V₉导联上。V₁、V₂、V₃、aVF、Ⅱ、Ⅲ（D错）为下间壁心肌梗死。